女，21岁，上切牙远中移位，间隙增宽，求治。检查：上切牙牙周探诊6mm，第一恒磨牙松动I度，牙周探诊6mm，X线片显示：上前牙区牙槽骨水平吸收，第一磨牙弧形吸收。诊断为
A. 快速进展型牙周炎
B. 慢性牙周炎
C. 局限性青少年牙周炎
D. 青春前期牙周炎
E. 弥散型青少年牙周炎

正确答案：C。局限性青少年牙周炎

解析：本题考查局限型侵袭性牙周炎。女，21岁，上切牙远中移位，间隙增宽，求治。检查：上切牙牙周探诊6mm，第一恒磨牙松动I度，牙周探诊6mm，X线片显示：上前牙区牙槽骨水平吸收，第一磨牙弧形吸收。诊断为局限性青少年牙周炎（C对）。临床上可见一类牙周炎，发生在全身健康的人，疾病进展迅速，有家族聚集性，将其称为侵袭性牙周炎，包含1989年旧分类青少年牙周炎、快速进展性牙周炎和青春前期牙周炎，新分类将侵袭性牙周炎分为局限型和广泛型。局限型病变局限于第一恒磨牙和切牙，第一磨牙的邻面有垂直型骨吸收，若近远中均有垂直型骨吸收则形成“弧形吸收”；在切牙区由于牙槽间隔窄，一般表现为水平型骨吸收。广泛型侵犯第一磨牙和切牙以外的牙数在三颗以上，有严重而快速的附着丧失和牙槽骨破坏，牙龈有明显的炎症，呈鲜红色，并可伴有龈缘区肉芽性增殖，易出血，可有溢脓。